治疗慢性肾小球肾炎可引起高血钾的药物是
A. α受体阻滞剂
B. 呋塞米
C. ACEI抑制药类
D. 钙拮抗剂
E. β受体阻滞剂

正确答案：C。ACEI抑制药类

解析：ACEI即血管紧张素转换酶抑制剂（C对），降压作用主要通过抑制血管紧张素转换酶使血管紧张素Ⅱ生成减少而发挥作用，血管紧张素Ⅱ是强烈的血管收缩剂和肾上腺皮质类醛固酮释放的激活剂，因此ACEI除降低血压外，还抑制醛固酮的释放，醛固酮的生理作用是保水保钠排钾，当醛固酮释放减少时，排钾作用减弱，将导致高钾血症。呋塞米（B错）为排钾性利尿剂，会使血钾降低。α受体阻滞剂（A错）、钙拮抗剂（D错）和β受体阻滞剂（E错）均有降压作用，但对血钾无明显影响。